《大医精诚》的作者是
A. 刘完素
B. 孙思邈
C. 张仲景
D. 林逋
E. 李时珍

正确答案：B。孙思邈

解析：本题考查《大医精诚》的作者。《大医精诚》的作者是孙思邈（B对）。《大医精诚》一文出自中国唐朝孙思邈所著之《备急千金要方》第一卷，乃是中医学典籍中，论述医德的一篇极重要文献，为习医者所必读。《大医精诚》论述了有关医德的两个问题：第一是精，亦即要求医者要有精湛的医术，认为医道是“至精至微之事”，习医之人必须“博极医源，精勤不倦”。第二是诚，亦即要求医者要有高尚的品德修养，以“见彼苦恼，若己有之”感同身受的心，策发“大慈恻隐之心”，进而发愿立誓“普救含灵之苦”，且不得“自逞俊快，邀射名誉”、“恃己所长，经略财物”。